上颌牙齿中体积最大的是
A. 上颌中切牙
B. 上颌尖牙
C. 上颌第一前磨牙
D. 上颌第一磨牙
E. 上颌第二磨牙

正确答案：D。上颌第一磨牙

解析：本题考查上颌牙的大小比较。上颌第一磨牙（D对）是上颌牙齿中体积最大的牙。观察上颌牙弓可见，切牙（A错）＜尖牙（B错）＜前磨牙（C错）＜磨牙，而在磨牙中，第三磨牙至第一磨牙体积逐渐增大，第三磨牙＜第二磨牙（E错）＜第一磨牙。